肺主通调水道的功能主要依赖于
A. 肺主一身之气
B. 肺呼吸
C. 肺输精于皮毛
D. 肺朝百脉
E. 肺主宣发和肃降

正确答案：E。肺主宣发和肃降

解析：本题考查肺主通调水道的功能，属于理解记忆内容。肺主行水的内涵主要有两个方面：一是通过肺气的宣发运动，将 脾气转输至肺的水液和水谷之精中的较轻清部分，向上向外布散，上至头面诸窍，外达全身 皮毛肌腠以濡润之；输送到皮毛肌腠的水液在卫气的推动作用下化为汗液，并在卫气的调节 作用下有节制地排出体外。二是通过肺气的肃降运动，将脾气转输至肺的水液和水谷精微中的较稠厚部分，向内向下输送到其他脏腑以濡润之，并将脏腑代谢所产生的浊液（废水） 下输至肾或膀胱，成为尿液生成之源。总之，肺以其气的宣发和肃降运动输布水液（E对）。